关于“液”的作用，说法正确的有
A. 灌注于骨节、脏腑、脑、髓，起润养作用
B. 质地较厚
C. 流动性小
D. 布散于体表皮肤、肌肉和孔窍，并能渗注于血脉，起滋润作用
E. 质地较薄

正确答案：A、B、C。灌注于骨节、脏腑、脑、髓，起润养作用；质地较厚；流动性小

解析：本题考查的是津液的生成与分布。关于“液”的作用，说法正确的有灌注于骨节、脏腑、脑、髓，起润养作用（A对）、质地较厚（B对）与流动性小（C对）。津液的生成与分布：津和液，同属于水液，来源于饮食，有赖于脾胃运化功能，以及小肠主液、大肠主津的功能活动而生成。由于津和液的性状、功能及分布部位有所不同，因而又有一定的区别。一般来说，质地较清稀（E错），流动性较大，布散于体表皮肤、肌肉和孔窍，并能渗注于血脉，起滋润作用（D错）的，称为津；质地较稠厚，流动性较小，灌注于骨节、脏腑、脑、髓等组织，起濡养作用的，则称为液。津和液之间可以相互转化，故津和液常同时并称。但在对“伤津”和“脱液”等进行辨证论治时，又须加以区别。